女性患儿，5岁，因其全口牙齿发黑前来就诊。家长代述近一周之内明显可以见到牙齿黑斑迅速增多，牙洞范围也迅速增大。且患儿平时睡前喜吃甜食，且对刷牙有抵触。检查发现在上、下乳前牙的切缘，乳尖牙的牙尖均有龋坏或者黑斑，且湿软，容易挖除。患儿平时不吃酸味的食物，怕牙齿痛。根据主诉与检查结果，以下的诊断最正确的是
A. 低龄儿童龋
B. 喂养龋
C. 环状龋
D. 猛性龋
E. 放射性龋

正确答案：D。猛性龋

解析：猛性龋的定义为突然发生、涉及牙位广泛，迅速地形成龋洞，早期波及牙髓，且常常发生于不易患龋的牙位和牙面上（如下前牙的切端、唇面等）。此点可以与低龄儿童龋相鉴别。掌握“乳牙龋”知识点。